食品生产经营人员有下列情形之一的，不得参加接触直接入口食品的工作。但除外
A. 患有痢疾
B. 患有伤寒
C. 患有病毒性肝炎
D. 渗出性皮肤病
E. 牙周炎

正确答案：E。牙周炎